神志活动的主要物质基础是
A. 血液
B. 肾精
C. 营气
D. 元气
E. 津液

正确答案：A。血液

解析：本题考查的是心的生理功能。神志活动的主要物质基础是血液（A对）。心主神志与心主血脉在生理上密切相关，血液是神志活动的物质基础，精神活动能调节和影响血液循环。病变时两者互为影响，血虚、血热等常可出现神志改变、心神不安，也可引起血行不畅。人体的生殖功能主要与肾有关。其一，肾藏先天之精，其携带遗传物质，促进人体胚胎发育，是生命起源的物质基础；其二，肾精（B错）能化生“天癸”。营气（C错）的生理功能：有营养人体和化生血液两方面。营气运行于全身血脉之中，成为血液的重要组成部分。元气（D错）的生理功能：推动和促进人体的生长发育，温煦和激发各脏腑、经络等组织器官的生理活动。元气是人体生命活动的原动力，是维持人体生命活动的最基本的物质。津液（E错），是体内各种正常水液的总称，包括各脏腑组织器官的内在体液及正常的分泌物，例如，胃液、唾液、肠液、关节液等。津液，也是构成人体和维持人体生命活动的基本物质。